发生突发公共卫生事件时，医疗机构的应急反应措施是
A. 评价应急处理措施效果
B. 组织、协调有关部门参与事件的处理
C. 督导、检查应急处理措施的落实情况
D. 开展病人接诊、收治和转运工作
E. 开展突发公共卫生事件的调查与处理

正确答案：D。开展病人接诊、收治和转运工作

解析：发生突发公共卫生事件时，医疗机构应当开展病人接诊、收治和转运工作（D对），即对因突发事件致病的人员提供医疗救护和现场救援，对就诊病人必须接诊治疗，实行重症和普通病人分开管理，并书写详细、完整的病历记录；对需要转送的病人，应当按照规定将病人及时病历记录的复印件转送至接诊的或者指定的医疗机构；对疑似病人及时排除或确诊。